治疗风寒感冒，寒湿带下，应选用的药物是
A. 葛根
B. 荆芥
C. 生姜
D. 白芷
E. 淡豆豉

正确答案：D。白芷

解析：白芷辛散温通，祛风解表散寒之力较温和，而以止痛、通鼻窍见长，宜于外感风寒，头身疼痛，鼻塞流涕之证，且本品辛温香燥，善除阳明经湿邪而燥湿止带，能治疗寒湿下注，白带过多（D对）。荆芥（B错）、生姜（C错）能治疗风寒感冒，但不能止带；葛根（A错）、淡豆豉（E错）性寒凉，既不能治疗风寒感冒，也不能治疗寒湿带下。